一个有关疾病家族史的问题被设计为：“您父母曾患糖尿病吗？①是②否③不清楚”。该问题的设计错误属于
A. 含糊不清
B. 抽象提问
C. 诱导性提问
D. 双重装填
E. 问题太敏感

正确答案：D。双重装填